男38岁，发热2周，胸闷5天，无咳嗽、咳痰和咯血，曾使用“三代头孢菌素”抗感染治疗无效。查体：T37.8℃，BP140/90mmHg，右下肺呼吸音消失，语音共振减弱，胸部X线片示右下肺大片状密度增高影，上缘呈外高内低弧形，为明确诊断应首选的检查是
A. 超声心动图
B. 支气管镜
C. 胸部CT
D. 胸腔穿刺抽液
E. 血肿瘤标志物

正确答案：D。胸腔穿刺抽液

解析：中青年患者，发热、胸闷，抗生素治疗无效，查体：T37.8℃（正常值为36℃～37℃），BP140/90mmHg（正常值为90～140/60～90mmHg），右下肺呼吸音消失，语音共振减弱（提示胸腔积液），胸部X线片示右下肺大片状密度增高影，上缘呈外高内低弧形（胸腔积液的典型X线表现），患者应诊断为胸腔积液，为明确诊断应首选的检查是胸腔穿刺抽液（D对），胸腔积液穿刺抽液对明确积液性质及病因诊断至关重要。